一位初产妇，妊娠39周，产前检查5次，妊娠经过顺利。今晨1时出现阵发性腹痛，不能入睡，坚持到早上8时到当地妇幼保健院就诊，门诊以妊娠足月临产收入院。入院后检查宫缩每5～6分钟一次，持续25～30秒，枕左前位，宫颈口开大2cm，余正常。在此产程阶段胎儿胎头下降速度应是
A. 下降不明显
B. 下降急速
C. 平均每小时下降0.86cm
D. 平均每小时下降1cm
E. 平均每小时下降1.2cm

正确答案：A。下降不明显